对不同历史阶段的医学科学发展和医学实践起着重要的导向作用的是
A. 方法论
B. 医学模式
C. 价值观
D. 技术
E. 理论

正确答案：B。医学模式